药品质量标准中，收载外观、臭味等内容的项目是
A. 性状
B. 鉴别
C. 检查
D. 含量测定
E. 类别

正确答案：A。性状

解析：本题考查药品标准。药品质量标准中，收载外观、臭味等内容的项目是性状（A对）。药品质量标准的性状项下主要记载药品的外观、臭味、溶解度以及物理常数。鉴别（B错）是指用规定的试验方法辨识药品与名称的一致性，即辨识药品的真伪，是药品质量控制的一个重要环节。《中国药典》检查（C错）项下包括反映药品的安全性与有效性的试验方法和限度、均一性与纯度等制备工艺要求等内容，检查项可分为一般检查与特殊检查。含量或效价测定（D错）是指用规定的方法测定药物中有效成分的含量。